痛风缓解期（关节炎症控制后1-2周）为控制血尿酸水平，应选用的药品是
A. 秋水仙碱
B. 别嘌醇
C. 布洛芬
D. 泼尼松龙
E. 聚乙二醇尿酸酶

正确答案：B。别嘌醇

解析：本题考查别嘌醇。痛风缓解期（关节炎症控制后1-2周）为控制血尿酸水平，应选用的药品是别嘌醇（B对）。痛风缓解期，应在关节炎控制后1～2周开始使用抑酸药别嘌醇，以控制血尿酸水平，减少尿酸结石所致关节骨破坏以及肾结石形成。秋水仙碱（A错）用于痛风的急性期、痛风性关节炎急性发作和预防。布洛芬（C错）主要用于风湿性及类风湿性关节炎。泼尼松龙（D错）属于激素类药物，具有抗炎止痛的作用，可用于痛风急性发作期缓解红肿热痛症状。聚乙二醇尿酸酶（E错）用于顽固性痛风的治疗。